糖原合成过程中，直接生成时需要消耗能量的物质是
A. 葡萄糖
B. 1-磷酸果糖
C. 6-磷酸果糖
D. 1-磷酸葡萄糖
E. 6-磷酸葡萄糖

正确答案：E。6-磷酸葡萄糖

解析：糖原合成过程中，直接生成时需要消耗能量的物质是6-磷酸葡萄糖，其生成需要消耗ATP。葡萄糖（A错）不直接参与糖原合成过程。1-磷酸果糖（B错）由特异的果糖激酶在肝内催化果糖磷酸化生成，不参与糖原合成。6-磷酸果糖（P113）（C错）是糖酵解的中间产物，不参与糖原合成。1-磷酸葡萄糖（P129）（D错）由6-磷酸葡萄糖变构形成，反应可逆，不耗能。